患者男性，65岁，下颌第一前磨牙牙周脓肿造成口底多间隙感染，双侧下颌下、舌下及颏部均有弥漫性肿胀，并波及面颊及颈部；皮下可扪及捻发音；患者出现呼吸困难，此时最佳的处理措施是
A. 气管切开
B. 穿刺抽脓
C. 应用大剂量抗生素
D. 局部理疗
E. 广泛切开引流

正确答案：E。广泛切开引流

解析：本题考查口底蜂窝织炎的治疗。患者口底多间隙感染，双侧下颌下、舌下及颏部均有弥漫性肿胀，并波及面颊及颈部；皮下可扪及捻发音；患者出现呼吸困难，此时最佳的处理措施是广泛切开引流（E对）。其切口可在双侧下颌下、颏下作与下颌骨平行的衣领形或倒T形切口。气管切开（A错）主要用于解除上呼吸道阻塞，一般用于急救中。由于面颈部广泛肿胀，穿刺抽脓（B错）已无法解决。应用大剂量抗生素（C错）、局部理疗（D错）均是口底蜂窝织炎的治疗处理，但由于患者弥漫性肿胀已经波及面颊及颈部，应该针对导致呼吸困难的病因处理，故应该广泛切开引流，缓解呼吸困难。